患儿口腔、舌上布满白屑，其诊断是
A. 口糜
B. 口疮
C. 燕口疮
D. 舌疳
E. 雪口

正确答案：E。雪口

解析：鹅口疮其特征为口腔、舌上蔓生白屑，又名雪口（E对）。口糜为满口糜烂，色红作痛者，为口疮之进展（A错）。口疮以齿龈、舌体、两颊、上颚等处出现黄白色溃疡，疼痛流涎，或伴发热为特征（B错）。燕口疮为溃疡只发生在口唇两侧者（C错）。舌疳如豆如菌痛烂红，渐若泛莲难饮食，绵溃久变瘰风（E错）。